胁痛的辩证，当以何者为主
A. 虚实
B. 阴阳
C. 气血
D. 寒热
E. 表里

正确答案：C。气血

解析：胁痛的辨证，首辨在气在血，次辨虚实。胀痛多属气郁，且疼痛游走不定，时轻时重，症状轻重与情绪变化有关；刺痛多属血瘀，且痛处固定不移，疼痛持续不已，局部拒按，入夜尤甚。且实证中，气滞、血瘀、湿热为主，三者又以气滞为先，所以首先辨别在气、在血，对辨证有重要意义（C对）。辨属虚属实，为次要的辨证要点（A错）。